女，32岁。大面积烧伤入院治疗14天后，突发寒战高热，脓痰，痰呈蓝绿色，一般情况恶化。考虑患者感染
A. 大肠埃希菌
B. 克雷伯杆菌
C. 铜绿假单孢菌
D. 链球菌
E. 金黄色葡萄球菌

正确答案：C。铜绿假单孢菌

解析：铜绿假单胞菌（C对）常见于烧伤后，表现为局部化脓性炎症，出现肺部感染时可有蓝绿色浓痰。大肠埃希菌（A错）通常引起胃肠炎以及肠道外感染，如败血症、新生儿脑膜炎、泌尿道感染等。肺炎克雷伯菌（B错）引发的肺炎病情轻一般较严重，肺部出现广泛出血、坏死性肺实变。链球菌（D错）可引起化脓性感染，超敏反应性疾病，中毒性疾病如猩红热等，肺炎链球菌主要引起人类大叶性肺炎。金黄色葡萄球菌（E错）易于引起侵袭性疾病，如皮肤化脓感染、各种器官以及全身感染；毒素性疾病，如食物中毒、烫伤样皮肤综合征、毒性休克综合征等。